妊娠期妇女拔牙较为安全的时间段是
A. 整个妊娠期
B. 妊娠第1、2、3月期间
C. 妊娠第4、5、6月期间
D. 妊娠第7、8、9月期间
E. 整个妊娠期均不能拔牙

正确答案：C。妊娠第4、5、6月期间

解析：本题考查妊娠期拔牙。妊娠期妇女拔牙较为安全的时间段是妊娠第4、5、6月期间（C对）。对于引起极大痛苦、必须拔除的牙，在健康正常者的妊娠期间皆可进行。但对选择性手术则应全面衡量。在怀孕的第4～6个月期间，进行拔牙或手术较为安全。对有流产、早产史者，更应注意。拔牙时应解除患者顾虑及恐惧，麻药中不加肾上腺素。